属于非离子表面活性剂的是
A. 羟苯乙酯
B. 聚山梨酯80
C. 苯扎溴铵
D. 硬脂酸钙
E. 卵磷脂

正确答案：B。聚山梨酯80

解析：本题考查非离子型表面活性剂。聚山梨酯80（B对）属于非离子型表面活性剂，表面活性剂分为阴离子表面活性剂、阳离子表面活性剂、两性离子表面活性、非离子表面活性剂和高分子表面活性剂等。羟苯乙酯（A错）为防腐剂；苯扎溴铵（C错）为阳离子表面活性剂；硬脂酸钙（D错）为阴离子表面活性剂；卵磷脂（E错）为两性离子表面活性剂。